根据《处方管理办法》，医疗机构处方保存期限为1年的有
A. 医疗用毒性药品处方
B. 普通处方
C. 急诊处方
D. 第二类精神药品处方
E. 儿科处方

正确答案：B、C、E。普通处方；急诊处方；儿科处方

解析：本题考查的是处方的监督管理。根据《处方管理办法》，医疗机构处方保存期限为1年的有普通处方（B对）、急诊处方（C对）、儿科处方（E对）。处方由调剂处方药品的医疗机构妥善保存。普通处方、急诊处方、儿科处方保存期限为1年，医疗用毒性药品（A错）处方保存期限为2年。麻醉药品、精神药品等特殊药品处方保存期限按照特别规定。处方保存期满后，经医疗机构主要负责人批准、登记备案，方可销毁。一般来说，处方销毁申请由处方保管人向药剂科主任提出，药剂科主任填写医院《处方销毁申请表》，报医务处、业务主管院长审批，由药剂科与医务处执行销毁。处方在销毁时，必须由两位药学专业技术人员核对销毁，并建立销毁记录，销毁后要及时做好销毁登记，监销人要进行双签字。医疗机构应当对麻醉药品和精神药品处方进行专册登记，加强管理。麻醉药品处方至少保存3年，精神药品（D错）处方至少保存2年。